益母草的药理作用有
A. 降血压
B. 兴奋子宫
C. 增强免疫功能
D. 抗血小板聚集
E. 增加冠脉流量

正确答案：A、B、C、D、E。降血压；兴奋子宫；增强免疫功能；抗血小板聚集；增加冠脉流量

解析：本题考查益母草的药理作用。益母草的药理作用有降血压（A对）、兴奋子宫（B对）、增强免疫功能（C对）、抗血小板聚集（D对）、增加冠脉流量（E对）。益母草【药理作用】1.与功效相关的主要药理作用：（1）兴奋子宫平滑肌（2）抗血栓（3）利尿、防治急性肾小管坏死（4）增强免疫功能（5）增加冠脉流量。2.其他药理作用：（1）抗心肌肥厚（2）抗心肌缺血（3）抗前列腺增生。药理作用：益母草煎剂、乙醇浸膏及益母草碱有兴奋子宫的作用；对小鼠有一定的抗着床和抗早孕作用。益母草注射液能保护心肌缺血再灌注损伤、抗血小板聚集、降低血液黏度。益母草粗提物能扩张血管，有短暂的降压作用。益母草碱有明显的利尿作用。